可引起嗜睡，司机、高空作业或操作机器者慎用的药物是
A. 氨溴索
B. 对乙酰氨基酚
C. 右美沙芬
D. 喷托维林
E. 伪麻黄碱

正确答案：C。右美沙芬

解析：本题考查药物不良反应。右美沙芬（C对）可引起嗜睡，对驾车、高空作业或操作机器者宜慎用。喷托维林（D错）可使驾驶员出现眩晕或幻觉。氨溴索（A错）是祛痰剂，通常能很好耐受，轻微的上部胃肠道副作用偶有报道(主要为胃部灼热、消化不良和偶尔出现的恶心、呕吐）。过敏反应极少出现，主要为皮疹，极少病例报道出现严重的急性过敏性反应。对乙酰氨基酚（B错）属于非甾体抗炎药、解热镇痛药，可引起药源性肝脏损害。伪麻黄碱（E错）对伴有心脏病、高血压、甲状腺功能亢进症、青光眼、肺气肿及前列腺增生症患者禁用，服药期间禁止饮酒。